18个月小儿，咳嗽1周，气促，精神正常，食欲尚可，无明显异物史。查体：体温37.8℃，双肺呼吸音粗糙及有不固定的干湿啰音，胸部X线显示，肺纹理增粗。根据病例诊断最大的可能是
A. 支气管异物
B. 肺结核
C. 急性支气管炎
D. 支气管炎
E. 哮喘性支气管炎

正确答案：C。急性支气管炎

解析：婴儿，咳嗽1周，气促，精神正常，食欲尚可，无明显异物史。查体：体温37.8℃（正常值为36℃～37℃，体温升高），双肺呼吸音粗糙及有不固定的干湿啰音（急性支气管炎的典型体征），胸部X线显示，肺纹理增粗，根据患儿的临床症状、体征及实验室检查，考虑最可能的诊断为急性支气管炎（C对），该病以咳嗽为主要症状，无全身症状。支气管异物（A错）有异物史，突然出现呛咳，可有肺不张和肺气肿。肺结核（B错）婴幼儿可急性起病，高热可达到39-40℃，但一般情况尚好，与发热不相称，持续2-3周后转为低热，并伴结核中毒症状，干咳和轻度呼吸困难是最常见的症状。支气管炎（D错）比急性支气管炎范围大、病程长。哮喘性支气管炎（E错）反复多次喘息发作，亲属有哮喘及变应性疾病史。